关于血脑屏障的说法，下列说法错误的是
A. 血脑屏障的构成为毛细血管内皮细胞，星形胶质细胞
B. 血脑屏障能够阻碍许多大分子物质通过
C. 血脑屏障能够阻碍解离型药物通过
D. 水溶性的药物能够透过血脑屏障
E. 脂溶性药物能够通过血脑屏障

正确答案：D。水溶性的药物能够透过血脑屏障

解析：脑组织内的毛细血管内皮细胞紧密相连，且毛细血管外表面几乎被星形胶质细胞包围，此种特殊结构形成了血浆与脑脊液之间的屏障。此屏障能够阻碍许多大分子、水溶性或解离性药物通过，只有脂溶性高的药物才能以简单扩散的方式通过血脑屏障。掌握“药物的吸收和分布”知识点。